男，5岁。发热，头痛，呕吐4天，昏迷半天于2月10日入院。查体：T39.6℃，P115次/分，R26次/分，BP60/25mmHg。神志不清，皮肤可见出血点，球结膜水肿，心肺腹（-），颈抵抗（+）双侧Babinski（+）。实验室检查：血WBC16.4×10⁹/L，中性粒0.88，淋巴细胞0.12。患者抢救无效于次日死亡。其脑组织病理检查最可能出现的结果是
A. 颅底多发性闭塞性动脉内膜炎，引起脑实质损害
B. 软脑膜充血、水肿、出血
C. 脑沟和脑回可见小的肉芽肿，结节和脓肿，蛛网膜下腔可见有胶样渗出物
D. 病变多发生在灰质，白质交界处，引起脑室扩大，脑积水及脑蛛网膜炎
E. 脑血管高度扩张充血，蛛网膜下腔充满黄色脓性分泌物

正确答案：E。脑血管高度扩张充血，蛛网膜下腔充满黄色脓性分泌物

解析：儿童患者，发热，头痛，呕吐4天，昏迷半天于2月10日入院，查体见皮肤出血点，以及一系列脑膜刺激症状，血白细胞（WBC）数量升高（正常值0-5×10⁶/L），考虑诊断为流行性脑脊髄膜炎，其脑组织病理检查可见：脑血管高度扩张充血，蛛网膜下腔增宽，充满黄色脓性分泌物（E对）。颅底多发性闭塞性动脉内膜炎，引起脑实质损害（A错）为结核性脑膜炎（P357）的病变特点。软脑膜充血、水肿、出血（B错）为流行性乙型脑炎（P334）的病变特点。脑沟和脑回可见小的肉芽肿，结节和脓肿，蛛网膜下腔可见有胶样渗出物（C错）为新型隐球菌性脑膜炎的病变特点。病变多发生在灰质、白质交界处，引起脑室扩大，脑积水及脑蛛网膜炎（D错）为脑囊虫病的病变特点。